上皮性根尖肉芽肿转变成根尖周囊肿的方式，哪项除外
A. 上皮团液化变性，渗透压增高发展为囊肿
B. 上皮覆盖脓腔，炎症缓解后转变为囊肿
C. 上皮包裹的肉芽组织发生退变、坏死形成囊肿
D. 上皮团中心营养障碍，周围组织液增多
E. 上皮团细胞不断增生，形成囊肿

正确答案：E。上皮团细胞不断增生，形成囊肿

解析：本题考查急慢性根尖周炎。上皮性根尖肉芽肿转变成根尖周囊肿的方式，上皮团细胞不断增生，形成囊肿（E错，为本题正确答案）除外。上皮性根尖肉芽肿，可以转变成根尖周囊肿，可以通过以下方式转化：①增生的上皮团中心部分由于营养障碍，液化变性，渗透压增高吸引周围组织液，进而发展成囊肿（AD对）；②增生的上皮被覆脓腔，当炎症缓解后转变成囊肿（B对）；③增生的上皮包裹的炎性肉芽组织也可发生退变、坏死形成囊肿（C对）。